治疗月经先期阳盛血热证，应首选
A. 丹皮、黄柏、熟地、白芍、茯苓、青蒿、地骨皮
B. 丹皮、黄柏、熟地、白芍、茯苓、阿胶、麦门冬
C. 丹皮、黄柏、熟地、白芍、山药、太子参、麦门冬
D. 当归、白芍、熟地、黑荆芥、柴胡、山药、茯苓、菟丝子
E. 当归、赤芍、熟地、黑荆芥、柴胡、茯苓、续断、女贞子

正确答案：A。丹皮、黄柏、熟地、白芍、茯苓、青蒿、地骨皮

解析：月经先期阳盛血热证因素体阳盛或过食辛燥助阳之品，或感受热邪，热扰冲任、胞宫，迫血下行，以致月经提前。治疗宜清热凉血调经，可以选用清经散加减，清经散的组成为：丹皮、地骨皮、白芍、熟地、青蒿、茯苓、黄柏（A对）